结构中不含有羧基的药物是
A. 阿司匹林
B. 布洛芬
C. 吲哚美辛
D. 双氯芬酸钠
E. 对乙酰氨基酚

正确答案：E。对乙酰氨基酚

解析：本题考查不含羧基的药物。结构中不含有羧基的药物是对乙酰氨基酚（E错，为本题正确答案）。对乙酰氨基酚为乙酰苯胺类解热镇痛药，其分子结构中含有酰胺键，不含羧基。阿司匹林（A对）为水杨酸类解热镇痛药，其分子结构中含有羧基。布洛芬（B对）为芳基丙酸类非甾体抗炎药，其分子结构中含有甲基、羧基。吲哚美辛（C对）为芳基乙酸类非甾体抗炎药，其分子结构中含有甲氧基、甲基、羧基。双氯芬酸（D对）为芳基乙酸类非甾体抗炎药，其分子结构中含有氨基、羧基。